正常小儿2周岁时，体重约为出生体重的
A. 1倍
B. 2倍
C. 3倍
D. 4倍
E. 5倍

正确答案：D。4倍

解析：本题考查体格生长常用指标。正常小儿2周岁时，体重约为出生体重的4倍（D对）。一般在3～4个月时体重可达出生时的2倍，1岁时达3倍（10kg）。